阵发性室上性心动过速不伴有心力衰竭者首选
A. 静滴利多卡因
B. 静注维拉帕米
C. 口服苯妥英钠
D. 静滴10%氯化钾
E. 口服美西律

正确答案：B。静注维拉帕米

解析：阵发性室上性心动过速若心功能与血压正常，可先尝试刺激迷走神经的方法。包括颈静脉窦按摩、Valsalva等。若效果不佳，首选的治疗药物为腺苷，如腺苷无效可改静注维拉帕米（B对）。当患者出现严重心绞痛、低血压、充血性心力衰竭表现，应立即电复律。利多卡因（九版药理学P196）（A错）主要治疗室性心律失常，如心脏手术、心导管术、急性心肌梗死或强心苷中毒所致的室性心动过速或心室纤颤。苯妥英钠（九版药理学P196）（C错）主要用于治疗室性心律失常，为洋地黄所致的室性心律失常的首选用药，亦可用于心肌梗死、心脏手术、心导管术等所致室性心律失常。对洋地黄中毒导致的快速性心律失常，如血钾浓度低则可静脉补氯化钾（P173）（D错）。美西律（P206）（E错）为ⅠB类抗心律失常药，适用于急、慢性室性快速性心律失常；常用于小儿先天性心脏病与室性心律失常。